女，45岁，大学教授。因车祸导致颅脑损伤，智力测验显示其智商为85分。同时有一位从未接受过正规教育的老人测得智商也是85分。心理治疗师认为前者的智力出现了问题，而后者正常。这一判断所遵循的原则是
A. 客观性原则
B. 中立性原则
C. 操作性原则
D. 保密性原则
E. 标准化原则

正确答案：A。客观性原则

解析：在应用心理测验时应坚持标准化原则、保密原则、客观性原则，客观性原则指对心理测试结果做出评价时要符合受试者的实际情况，老人和大学教授的智力测验结果都是85分，但老人从未接受过正规教育，而教授接受过高等教育，且有车祸导致的颅脑损伤，因此心理治疗师判断前者的智力正常而后者出现了问题是遵循了客观性原则（A对）。标准化原则（E错）指采用公认的标准化工具，严格根据测验指导手册的规定执行心理测验。保密性原则（D错）指对测验的内容、答案及记分方法、受试者测验结果进行保密。中立性原则（B错）是治疗者对治疗中涉及的各类事件保持客观、中立的立场，不把个人的观点强加于患者。操作性原则（C错）教材未明确提及。